某女，43岁，妊娠后出现胎漏、胎动不安，同时又见目暗不明。宜选用的药是
A. 女贞子
B. 覆盆子
C. 菟丝子
D. 楮实子
E. 五味子

正确答案：C。菟丝子

解析：本题考查的是菟丝子的主治病证。妊娠后出现胎漏、胎动不安，同时又见目暗不明。宜选用的药是菟丝子（C对）。菟丝子：【主治病证】（1）肾虚之腰膝酸痛、阳痿、滑精、尿频、白带过多。（2）肝肾不足之目暗不明。（3）脾虚便溏或泄泻。（4）肾虚之胎漏、胎动不安。（5）阴阳两虚之消渴。女贞子（A错）：【主治病证】（1）肝肾阴虚之头晕目眩、腰膝酸软、须发早白。（2）阴虚发热。（3）肝肾虚亏之目暗不明，视力减退。覆盆子（B错）：【主治病证】（1）肾虚不固之遗精滑精、遗尿尿频。（2）肾虚阳痿。（3）肝肾不足之目暗不明。楮实子（D错）：【主治病证】（1）肝肾不足，腰膝酸软，虚劳骨蒸。（2）头晕目昏，目生翳膜。（3）水肿胀满。五味子（E错）：【主治病证】（1）肺虚久咳或肺肾不足之咳喘。（2）津伤口渴，消渴。（3）表虚自汗，阴虚盗汗。（4）肾虚遗精、滑精。（5）脾肾两虚之五更泄泻。（6）虚烦心悸，失眠多梦。